治疗痰湿阻滞型闭经的最佳方剂为
A. 小青龙汤
B. 芎归二陈汤
C. 导痰汤
D. 二陈汤
E. 四君子汤合苍附导痰丸

正确答案：E。四君子汤合苍附导痰丸

解析：闭经痰湿阻滞由于素体脾虚或饮食不节伤脾，脾虚运化失司，肾虚不能化气行水，水湿内停，聚湿生痰，或痰湿之体，痰湿阻滞冲任二脉，或结块，使血不得下行而闭经，应健脾燥湿化痰，活血调经,主方四君子汤合苍附导痰丸（E对）。小青龙汤功用解表散寒，温肺化饮（A错）。芎归二陈汤功用燥湿化痰（B错）。导痰汤功用燥湿化痰，行气开郁（C错）。二陈汤功用燥湿化痰，理气和中（D错）。